产褥妇，26岁。剖宫产术后16天，突然阴道大量流血3小时来院。入院时BP84/60mmHg，心率122次/分，Hb84g/L。该患者应立即釆取的处理措施不包括
A. 行B超检查
B. 建立静脉通道，补液、输血
C. 行清宫术止血
D. 静滴缩宫素
E. 静滴广谱抗生素预防感染

正确答案：C。行清宫术止血

解析：青年产褥妇，剖宫产术后16日（＞24小时），突然阴道大量流血3小时来院，入院时BP84/60mmHg（血压低于90/60mmHg为低血压），心率122次/分（正常心率为60～100次/分，该患者心动过速），Hb84g/L（正常血红蛋白含量为115～150g/L），诊断为晚期产后出血。该患者有剖宫产史，并出现休克症状，最可能的出血原因是子宫切口裂开出血。应采取的措施为B超检查（A对）以明确出血量及部位；静脉输液、备血（B对）抗休克治疗，给予广谱抗生素（E对），静滴缩宫素（D对）以减少出血，若多量阴道流血应行剖腹探查手术。此时严禁行清宫术止血（C错，为本题正确答案），其适用于疑有胎盘、胎膜、蜕膜残留或胎盘附着部位复旧不全者。